描述性研究不包括
A. 生态学研究
B. 横断面调查
C. 队列研究
D. 个案研究
E. 病例报告

正确答案：C。队列研究

解析：本题考查描述性研究的分类。描述性研究常见的类型主要有：现况研究、生态学研究（A对）、病例报告（E对）、病例系列分析、个案研究（D对）、历史资料分析、随访研究等。现况研究又被称为横断面研究（B对）和患病率研究。队列研究（C错，为本题正确答案）属于分析性研究。